男，20岁。因交通事故头顶部可见直径10cm血肿，意识清楚，恶心呕吐，烦躁，急救处置时不恰当的措施是
A. 血压脉搏呼吸监测
B. 注意意识状态
C. 穿刺抽吸头皮下血肿
D. 给予镇静剂
E. 给予脱水剂

正确答案：C。穿刺抽吸头皮下血肿

解析：患者车祸后出现头顶部直径为10cm的血肿，血肿较大，无法确定是帽状腱膜下血肿还是骨膜血肿，也无法确定患者是否合并颅骨骨折。若患者合并颅骨骨折，则穿刺抽吸头皮下血肿可致压力骤减而发生脑疝，故急救时穿刺抽吸头皮下血肿（C错，为本题正确答案）为不恰当的处置。患者意识清楚，但有恶心、呕吐的表现，此为脑水肿的表现，可给予脱水剂（E对）以缓解脑水肿的症状。患者因暴力损伤头部，所以不能排除颅内损伤的可能性，故应监测患者血压、脉搏、呼吸（A对）、注意意识状态（B对），若患者出现烦躁等症状，可给予镇静剂（D对）。